中华人民共和国药典是
A. 由国家颁布的药品集
B. 由国家医药管理局制定的药品标准
C. 由卫生部制定的药品规格标准的法典
D. 由国家编纂的药品规格标准的法典
E. 由国家制定颁布的制剂手册

正确答案：D。由国家编纂的药品规格标准的法典

解析：本题考查药典。中华人民共和国药典是由国家编纂的药品规格标准的法典（D对）。药典是一个国家记载药品标准、规格的法典，一般由国家药典委员会组织编写，并由政府颁布、执行，具有法律约束力。药典为国家对药品质量进行监督、管理的法定技术标准，而非药品集（A错）或制剂手册（E错）。药典由国家药典委员会编制和修订，而非国家医药管理局（B错）或卫生部制定标准（C错）。